影响药物转运的因素不包括
A. 药物的脂溶性
B. 药物的解离度
C. 体液的pH
D. 胎盘屏障
E. 血脑屏障

正确答案：D。胎盘屏障